按苷键原子不同，苷被酸水解的易难顺序是
A. C-苷＞S-苷＞O-苷＞N-苷
B. S-苷＞O-苷＞C-苷＞N-苷
C. N-苷＞O-苷＞S-苷＞C-苷
D. N-苷＞S-苷＞O-苷＞C-苷
E. C-苷＞O-苷＞S-苷＞N-苷

正确答案：C。N-苷＞O-苷＞S-苷＞C-苷

解析：本题考查的是苷键的酸催化水解。按苷键原子不同，苷被酸水解的易难顺序是N-苷＞O-苷＞S-苷＞C-苷（C对）。按苷键原子不同，酸水解的易难顺序为：N-苷＞O-苷＞S-苷＞C-苷。C上无未共享电子对，不能质子化，很难水解。而N碱度大，易接受质子，故最易水解。但当N原子处于嘧啶或酰胺位置时，也难于用无机酸水解。